参与酮体和胆固醇合成的酶是
A. 果糖二磷酸酶-1
B. 6-磷酸果糖激酶-1
C. HMG-CoA还原酶
D. 磷酸化酶
E. HMG-CoA合成酶

正确答案：E。HMG-CoA合成酶

解析：酮体和胆固醇合成的共同步骤有两个：①2分子乙酰CoA在乙酰乙酰CoA硫解酶作用下缩合成乙酰乙酰CoA；②乙酰乙酰CoA与1分子乙酰CoA在HMG-CoA合成酶（E对）作用下缩合成HMG-CoA。果糖二磷酸酶-1（A错）是糖异生过程中的关键酶。6-磷酸果糖激酶（B错）是糖酵解途径的关键酶。HMG-CoA还原酶（C错）是胆固醇合成的关键酶。磷酸化酶（D错）可将供体的磷酸基团转移到受体上，如糖原磷酸化酶，它是糖原分解过程中的关键酶。